胸片可见环形透亮区、肺门上提、肺纹呈垂柳状改变的多为
A. Ⅰ型肺结核
B. Ⅱ型肺结核
C. Ⅲ型肺结核
D. Ⅳ型肺结核
E. Ⅴ型肺结核

正确答案：C。Ⅲ型肺结核

解析：1、原发性肺结核，即Ⅰ型肺结核（A错）X线哑铃状，一般会给出肺门淋巴结大。2、血型播散型肺结核，即Ⅱ型肺结核（B错）急性粟粒型结核多见于婴幼儿、青少年，X线表现为全肺（肺尖-肺底）大小、密度、分布“三均匀”；亚急性、慢性多见于成人，X线双中上肺野大小、密度、分布“三不均”。3、继发型肺结核，即Ⅲ型肺结核，包括渗出型肺结核、增殖型肺结核、干酪型肺炎结核球或空洞等，其中慢性纤维空洞型肺结核，病程长，反复进展恶化，X线可见肺门抬高，肺纹理垂柳样（C对），纤维厚壁空洞形成。4、结核型胸膜炎，即Ⅳ型肺结核（D错），在病情发展的不同阶段有干性胸膜炎，渗出性胸膜炎及结核性脓胸等表现，以结核性渗出性胸膜炎最常见。5、肺外结核，即Ⅴ型肺结核（E错），如结核性脑膜炎、骨结核、结核性腹膜炎、肠结核以及泌尿生殖系统结核等。